崩解时限为60min
A. 普通压制片
B. 分散片
C. 糖衣片
D. 咀嚼片
E. 口含片

正确答案：C。糖衣片

解析：本题考查片剂的崩解时限。崩解时限为60min的是糖衣片（C对）。糖衣片应在1小时内全部崩解。普通压制片（A错）应在15分钟内全部溶解。分散片（B错）、可溶片应在3分钟内全部崩解并溶化。咀嚼片（D错）不需做崩解时限检查；含片（E错）应在30min内全部崩解或溶化。